在经皮给药制剂中，可用作背衬层材料的是
A. 聚苯乙烯
B. 微晶纤维素
C. 乙烯-醋酸乙烯共聚物
D. 硅橡胶
E. 低取代羟丙基纤维素

正确答案：A。聚苯乙烯

解析：本题考查经皮给药制剂的处方材料。聚苯乙烯（A对）常用作背衬层材料；微晶纤维素（B错）为片剂填充剂；乙烯-醋酸乙烯共聚物（C错）为控释膜材料；硅橡胶（D错）为制剂的压敏胶材料的一种；低取代羟丙基纤维素（L-HPC）（E错）为片剂崩解剂。